儿童苯丙酮尿症的确诊检查是
A. 血TSH测定
B. 染色体核型分析
C. 尿三氯化铁试验
D. 尿蝶呤分析
E. 血浆氨基酸分析

正确答案：E。血浆氨基酸分析

解析：儿童苯丙酮尿症的确诊检查是血浆氨基酸分析（E对），即测定血清苯丙氨酸浓度，血清苯丙氨酸浓度的测定主要用于筛查实验阳性患者的确诊。血TSH是甲亢或甲减的确诊方法（A错）。染色体核型分析是唐氏综合症的确诊方法（B错）。尿三氯化铁试验（C错）及2，4—二硝基苯肼试验用于较大儿童的初筛（七版儿科学），阳性者需进一步做血苯丙氨酸测定才能确诊。尿蝶呤分析（D错）主要用于苯丙酮尿症经典型和非经典型的分析鉴别。